患者，女，32岁。饱餐后出现上腹剧痛、恶心呕吐，呕后腹痛反而加重，服解痉剂无效。检查：体温39℃，心率120次／分，多汗，上腹紧张，有压痛、反跳痛，血清淀粉酶320u，血钙1.63mmol/L。应首先考虑的是：
A. 急性心肌梗死
B. 溃疡病穿孔
C. 急性胰腺炎
D. 急性阑尾炎
E. 急性肠梗阻

正确答案：C。急性胰腺炎

解析：患者饱餐后出现上腹剧痛、恶心呕吐，呕后腹痛反而加重，服解痉剂无效。检查：体温39℃，心率120次／分，多汗，上腹紧张，有压痛、反跳痛，血清淀粉酶320u（正常值30-220 SI U/L），血钙1.63mmol/L（正常值 血清离子钙1.10-1.34mmol/L）。腹痛为急性胰腺炎的主要和首发症状，常于饱餐、饮酒、或脂肪餐后突然发作，腹痛剧烈，呈绞痛、钻痛或刀割样，为持续性疼痛伴阵发性加剧，多位于中上腹或左上腹。出现压痛、反跳痛等急性腹膜炎症状，提示重症急性胰腺炎，综合该患者的病史、体查、实验室检查，该患者诊断考虑为急性胰腺炎（C对）。急性心肌梗死主要表现为心前区疼痛，可放射至左臂及背部，依据典型的心电图改变及血清肌钙蛋白和心肌酶的改变，一般可诊断（A错）。溃疡病穿孔主要表现为突发上腹部剧烈疼痛，并迅速向全腹蔓延，伴急性腹膜炎体征，腹部X线检查发现膈下游离气体影，是诊断穿孔的重要依据（B错）。急性阑尾炎的典型的腹痛的发作始于右上腹，数小时（6-8小时）后转移并固定在右下腹，检体麦氏点压痛及反跳痛，腹肌紧张，肠鸣音减弱等，实验室检查白细胞计数和中性粒细胞比例增高（D错）。急性肠梗阻的临床表现为腹痛、呕吐、腹胀及停止自肛门排气排便。一般肠梗阻发生4-6小时，X线检查即显示出肠腔内气体（E错）。